代谢性碱中毒对机体的影响中例外的是
A. 脑内GABA生成减少
B. 脑组织缺氧
C. 血清游离钙明显增多
D. 低钾血症
E. 脑内GABA分解增强

正确答案：C。血清游离钙明显增多

解析：代谢性碱中毒时因 pH值增高, γ-氨基丁酸转氨酶活性增强，γ-氨基丁酸（GABA）分解加强而生成减少（AE对），血液pH升高可使血红蛋白与02的亲和力增强，血红蛋白不易将结合的02释出，而造成脑组织缺氧（B对）， pH值升高也使血浆游离钙减少（C错，为本题正确答案），神经肌肉的应激性增高。碱中毒时，细胞外H+浓度降低，细胞内H+与 细胞外K交换；同时，由于肾小管上皮细胞在H+减少时，H+-Na +交换减弱而K +-Na +交换增强，使K +大量从尿中丢失，导致低钾血症（D对）。